关于固有牙槽骨不正确的为
A. 衬于牙槽窝的内壁
B. 又称筛状板
C. 属于束状骨
D. X线上称硬骨板
E. X线片上为围绕牙根的黑色透光带

正确答案：E。X线片上为围绕牙根的黑色透光带

解析：固有牙槽骨在X线片上表现为围绕牙根连续的致密白线，又称为“硬骨板”衬于牙槽窝内壁，包绕牙根与牙周膜相邻，在牙槽嵴处与外骨板相连，为一层多孔的骨板，又称“筛状板”，有大量的胶原纤维埋入，故又称“束骨”。掌握“牙槽骨”知识点。